双侧上颌后牙游离端缺失者，设计义齿时应该选用的大连接体形式为
A. 前腭杆
B. 后腭杆
C. 联合卡环
D. 腭板
E. RPA卡环组

正确答案：D。腭板

解析：腭板：前腭杆向前延伸至前牙舌隆突上而形成前腭板，再向左右两侧延伸形成马蹄状腭板（双侧游离缺失者）。故双侧后牙游离端缺失者应该选用腭板作为义齿的大连接体。掌握“局部义齿连接体”知识点。